关于腮腺多形性腺瘤手术的叙述中，错误的是
A. 单纯肿瘤摘除术
B. 将肿瘤连同周围腮腺组织一并切除术
C. 肿瘤在浅叶时，将肿瘤和腮腺浅叶一并切除术
D. 肿瘤在深叶时，将肿瘤连同全腮腺切除术
E. 各种术式均要保留面神经

正确答案：A。单纯肿瘤摘除术

解析：本题考查腮腺多形性腺瘤的手术治疗。因腮腺多形性腺瘤为临界性肿瘤，包膜不完整，如行单纯摘除术（A错，为本题的正确答案）易造成术后复发。多形性腺瘤的治疗为手术切除，不能作单纯肿瘤摘除而应将肿瘤连同周围腮腺组织一并切除（B对）。肿瘤在浅叶时，将肿瘤和腮腺浅叶一并切除（C对）；肿瘤在深叶时，将肿瘤连同全腮腺切除（D对）。在可能的情况下，各种术式均要保留腮腺咬肌筋膜、腮腺主导管及面神经（E对）。